不属于哌替啶适应证的是
A. 术后镇痛
B. 人工冬眠
C. 支气管哮喘
D. 麻醉前给药
E. 心源性哮喘

正确答案：C。支气管哮喘